下述情况可选用的灭菌方法是：安瓿
A. 干热灭菌法
B. 热压灭菌法
C. 紫外线灭菌法
D. 滤过除菌
E. 流通蒸汽灭菌法

正确答案：A。干热灭菌法